子宫底与子宫体上部的淋巴管主要注入
A. 骶淋巴结
B. 腹股沟深淋巴结
C. 髂内淋巴结
D. 髂外淋巴结
E. 腰淋巴结

正确答案：E。腰淋巴结

解析：子宫底与子宫体上部的淋巴管主要注入腰淋巴结（E对），后又沿着子宫圆韧带穿过腹股沟管注入腹股沟浅淋巴（B错）。